患者，男，50岁。慢性支气管炎病史5年。近2～3个月咳嗽加重，痰中持续带血，伴胸闷，气急，胸痛。X线检查见肺门阴影增大。应首先考虑的是
A. 慢性支气管炎
B. 原发性支气管肺癌
C. 肺炎
D. 肺结核
E. 肺脓肿

正确答案：B。原发性支气管肺癌

解析：患者为老年慢性支气管炎患者，往有慢性支气管炎病史。，近两到三个月咳嗽痰中带血，影像学提示肺门阴影增大， 综上所述该病人应考虑为中央型肺癌（B对）。单纯的慢性支气管炎（A错）由于不累及肺血管破裂和不累及胸膜，不会出现痰中带血以及胸痛。肺炎（C错）多有上呼吸道感染的前驱症状，主要表现为发热、咳嗽等，且病程较短。肺结核患者有较密切的结核病接触史，起病可急可缓，多为低热（午后为著）、盗汗、乏力、纳差、消瘦、女性月经失调等；呼吸道症状有咳嗽、咳痰、咯血、胸痛、不同程度胸闷或呼吸困难（D错）。肺脓肿（E错）临床特征为高热、咳嗽、咳大量脓臭痰。X线胸片可见一个或多发的含气液平的空洞。